小柴胡汤的组成药物中不含有的是
A. 柴胡
B. 黄芩
C. 干姜
D. 人参
E. 大枣

正确答案：C。干姜

解析：该题考查小柴胡汤的组成，属记忆内容。小柴胡汤功用和解少阳，由柴胡（A错）、黄芩（B错）、人参（D错）、甘草、半夏、生姜、大枣（E错）组成，不包括干姜（Ｃ对）。记忆：小柴胡汤和解功，半夏人参甘草从，更加黄芩生姜枣，少阳为病此方宗。